以下哪项为朗格汉斯细胞组织细胞增生症的分类
A. 纤维结构不良
B. 巨细胞肉芽肿
C. 勒-雪病
D. McCune-Albright综合征
E. 骨巨细胞瘤

正确答案：C。勒-雪病

解析：本题考查朗格汉斯细胞组织细胞增生症的分类。勒-雪病（C对）是朗格汉斯细胞组织细胞增生症的分类之一。朗格汉斯细胞组织细胞增生症通常根据疾病的严重程度，可分为以下三种类型：嗜酸性肉芽肿、汉-许-克病及勒-雪病，这些病损由于发病年龄、病变部位和朗格汉斯细胞增生的程度不同，而出现不同的症状、病程及预后。勒-雪病为急性播散型，是最严重的一型。纤维结构不良（A错）又称为纤维异常增殖症，可累及单骨或多骨。McCune-Albright综合征（D错）为多骨性损害同时伴有皮肤色素沉着和女性性早熟等内分泌异常。巨细胞肉芽肿（B错）为多核巨细胞的颌骨病变。骨巨细胞瘤（E错）是一种交界性、行为不确定的肿瘤。